既要维护患者利益，又要兼顾社会公益的具体表现
A. 尊重病人的知情同意权，但要控制病人选择的权利
B. 一视同仁地对待各种病人
C. 对特殊的精神病人和意识模糊的病人，服务可以滞后一般病人
D. 敢于批评有损患者利益的现象，但不宜采取行动抵制，要用温和的方式保护病人的生命与健康
E. 对因病态心理支配有过激行为的病人，应心尽快联系公安人员处理，使之远离医院

正确答案：B。一视同仁地对待各种病人